口腔黏膜出现蓝黑色色素沉着多见于
A. 麻疹
B. 鹅口疮
C. 系统性红斑狼疮
D. 肾上腺皮质功能减退
E. 维生素C缺乏

正确答案：D。肾上腺皮质功能减退

解析：正常人的口腔黏膜光洁呈粉红色。口腔黏膜出现蓝黑色色素沉着多见于肾上腺皮质功能减退（D对）。麻疹（A错）可在相当于第二磨牙处的颊粘膜出现直径约1mm的灰白色小点，外有红色晕圈，称为麻疹黏膜斑。鹅口疮（B错）为白色念珠菌感染所致，可出现乳白色薄膜覆盖于口腔黏膜、口角等处。系统性红斑狼疮（C错）可出现无痛性黏膜溃疡。维生素C缺乏（E错）可在黏膜下出现大小不等的出血点或瘀斑。